队列研究属于哪一种流行病学研究方法
A. 描述流行病学
B. 分析流行病学
C. 实验流行病学
D. 理论流行病学
E. 临床试验

正确答案：B。分析流行病学

解析：本题考查流行病学研究方法类型。流行病学研究方法包括观察法、实验法、和数理法。观察法包括描述流行病学和分析流行病学。分析流行病学（B对ACDE错）包括队列研究和病例对照研究。